在现代社会，人类的健康除了会受到遗传因素影响，还会受到的影响因素是
A. 心理因素
B. 社会因素
C. 环境因素
D. 经济因素
E. 自然因素

正确答案：C。环境因素

解析：本题考查影响人类健康的因素。在现代社会，人类的健康除了会受到遗传因素影响，还会受到环境因素（C对ABDE错）的影响。